某男，64岁。皮肤突发风团，大片色红，瘙痒剧烈，伴脘腹疼痛，恶心呕吐，神疲纳呆，大便秘结；舌红苔薄黄，脉弦滑数，应采用的治法
A. 疏风散寒止痒
B. 疏风解表，通腑泄热
C. 疏风清热止痒
D. 养血祛风，润燥止痒
E. 健脾益气，散风泄热

正确答案：B。疏风解表，通腑泄热

解析：本题考查瘾疹之胃肠湿热证的治法。结合患者症状为瘾疹之胃肠湿热证，应采用的治法为疏风解表，通腑泄热（B对）。瘾疹之胃肠湿热证【症状】风团大片色红，瘙痒剧烈；发疹的同时伴脘腹疼痛，恶心呕吐，神疲纳呆，大便秘结或泄泻。舌质红，苔薄白或黄，脉弦滑数。【治法】疏风解表，通腑泄热。瘾疹之风寒束表证【症状】风团色白，遇寒加重，得暖则减；伴恶寒，口不渴。舌质淡红，苔薄白，脉浮紧。【治法】疏风散寒止痒（A错）。瘾疹之风热犯表证【症状】风团鲜红，灼热剧痒，遇热则剧，得冷则减；伴发热，恶寒，咽喉肿痛。舌质红，苔薄白或薄黄，脉浮数。【治法】疏风清热止痒（C错）。瘾疹之血虚风燥证【症状】反复发作，迁延日久，午后或夜间加剧；伴心烦易怒，口干，手足心热。舌红少津，脉沉细。【治法】养血祛风，润燥止痒（D错）。